不符合慢性肺心病心电图表现的是
A. 电轴右偏
B. Sv₁+Rv₅≥1.05mV
C. 右束支传导阻滞
D. V1和V2导联出现QS波
E. 肺型P波

正确答案：B。Sv₁+Rv₅≥1.05mV

解析：慢性肺心病时，肺循环阻力增加导致肺动脉高压，右心发挥其代偿功能，以克服升高的肺动脉阻力而发生右心室肥厚，心电图可见电轴右偏（A对）、V₁和V₂导联出现QS波（D对）、肺型P波（E对），慢性肺心病时右心肥大，导致右束支不应期延长，传导速度减慢，右束支会发生传导阻滞，因此会有右束支传导阻滞心电图表现（C对）。SⅤ₁+RⅤ₅≥4.0mV表示左室肥大，RV₁+SV₅≥1.05mV是慢性肺心病右室肥大的表现，故选SV₁+RV₅≥1.05mV（B错，为本题正确答案）。